郁金的功效是
A. 利尿通淋
B. 活血止痛
C. 行气解郁
D. 凉血清心
E. 利胆退黄

正确答案：B、C、D、E。活血止痛；行气解郁；凉血清心；利胆退黄

解析：本题考查的是郁金的功效。郁金的功效是活血止痛（B对）、行气解郁（C对）、凉血清心（D对）与利胆退黄（E对）。郁金：【功效】活血止痛，行气解郁，凉血清心，利胆退黄。牛膝：【功效】活血通经，利尿通淋（A错），引血下行，补肝肾，强筋骨。